男，46岁，确诊急性白血病1年，拟行异基因造血干细胞移植。有利于提高移植物存活最重要的措施是
A. HLA配型相同
B. 血型相同
C. 输注血液制品前辐照
D. 输注间充质干细胞
E. 适时应用免疫抑制药物

正确答案：A。HLA配型相同

解析：能引起强烈排斥反应的移植抗原称为主要组织相容性抗原，在人类最重要者为HLA抗原，且HLA型别匹配程度是决定供、受者组织相容性的关键因素，故患者拟行基因造血干细胞移植，需要HLA配型相同（A对），这样可以有利于提高移植物存活。血型相同（B错）也是移植的要求之一，但是不是提高移植物存活最重要的措施。输注血液制品前辐照（C错）、输注间充质干细胞（D错）、适时应用免疫抑制药物（E错）都属于移植物和受者的预处理，不是提高移植物存活最重要的措施。